一般要求医院感染漏报率不超过
A. 0.05
B. 0.08
C. 0.1
D. 0.15
E. 0.2

正确答案：E。0.2